某县有年均人口10万人，1997年因各种原因死亡1000人。该年共发生结核300人，原有结核400人，1997年共有60人死于结核，请问：该县的总死亡率为
A. 300/10万
B. 60/1000
C. 60/10万
D. 1000/10万
E. 资料不足，不能计算

正确答案：D。1000/10万

解析：本题考查死亡率的计算。死亡率表示在一定期间内，某人群中总死亡人数在该人群中所占的比例。计算时分子为某人群某年总死亡人数，分母为该人群平均人口数，算得总死亡率为1000/10万（D对ABCE错）。